下列哪一项不是有机磷中毒的烟碱样症状
A. 全身紧束感
B. 全身肌肉痉挛
C. 呼吸麻痹
D. 肌力增加
E. 眼睑、舌、肌肉震颤

正确答案：D。肌力增加